可引起亚急性细菌性心内膜炎的病原体是
A. 艰难梭菌
B. 苍白密螺旋体
C. 甲型溶血性链球菌
D. 白假丝酵母菌（白念珠菌）
E. 变异链球菌

正确答案：C。甲型溶血性链球菌

解析：可引起亚急性细菌性心内膜炎的病原体是甲型溶血性链球菌（草绿色链球菌）（C对），也可成为脑、肝和腹腔内感染的病原菌，当拔牙或摘除扁桃体时，寄居在口腔、龈隙中的这类细菌可侵入血流引起菌血症；一般情况下，少量菌会被吞噬细胞清除，但在心瓣膜有病损或人工瓣膜患者，细菌就可停留繁殖，引起亚急性细菌性心内膜炎。变异链球菌（E错）是口腔主要的致龋齿菌之一（P102）。艰难梭菌（A错）是人类肠道中正常菌群之一，耐药的艰难梭菌可引起抗生素相关性腹泻和假膜性结肠炎（P137）。苍白密螺旋体（B错）引起梅毒（P204）。白念珠菌（D错），即白假丝酵母菌，属假丝酵母菌属，是真菌的一种，为机会致病菌，可引起皮肤黏膜感染，内脏感染，中枢神经系统感染（P339）。